结构与甲状腺素类似，可影响甲状腺素代谢的是
A. 盐酸普鲁卡因胺
B. 奎尼丁
C. 多非利特
D. 盐酸普罗帕酮
E. 胺碘酮

正确答案：E。胺碘酮

解析：本题考查胺碘酮。胺碘酮（E对）结构与甲状腺素类似，含有碘原子，可影响甲状腺素代谢。盐酸普鲁卡因（A错）结构为对氨基苯甲酰胺。奎尼丁（B错）是生物碱。多非利特（C错）结构为甲磺酰胺。盐酸普罗帕酮（D错）结构为苯丙酮。